在健康信念模式中，促进个体行为改变的关键事件和暗示称为
A. 对疾病易感性的认识
B. 自我效能
C. 行为能力
D. 对疾病严重性的认识
E. 行为线索

正确答案：E。行为线索

解析：在健康信念模式中，促进个体行为改变的关键事件和暗示称为行为线索（E对）。行为线索是导致个体改变行为的“最后推动力”，包括内在和外在两方面。内在线索包括身体出现不适的症状等；外在线索包括传媒有关健康危险行为严重后果的报道、医生的劝告、家人或朋友的患病体验等。对疾病易感性的认识（A错）指个体对行为会危害自己健康或患病可能性的敏感程度。自我效能（B错）指个体对自己能力的评价和判断。行为能力（C错）不属于该理论的理论要点。对疾病严重性的认识（D错）指个体对危险后果的预期。